下列选项中不适合用早期筛检的是
A. 宫颈癌
B. 肺癌
C. 直肠癌
D. 乳腺癌
E. 结肠癌

正确答案：B。肺癌

解析：本题考查病程偏倚。病程偏倚是指如果筛查组中疾病进展缓慢的病人（肺癌（B对ACDE错）腺癌）占较大比例时，可能观察到筛查组较未筛查组生存概率更高或生存时间更长的现象。因此，肺癌不适用于早期筛查，否则则容易产生病程偏倚。